患儿，5岁。近日不思饮食，嗳腐酸馊，脘腹胀满，疼痛拒按，大便酸臭，夜寐不安，手足心热，苔白厚腻，脉弦滑。治宜选用的方剂是
A. 消乳丸
B. 健脾丸
C. 枳术丸
D. 保和丸
E. 二陈汤

正确答案：D。保和丸

解析：本题考查的是积滞的辨证论治。患儿，5岁。近日不思饮食，嗳腐酸馊，脘腹胀满，疼痛拒按，大便酸臭，夜寐不安，手足心热，苔白厚腻，脉弦滑。治宜选用的方剂是保和丸（D对）。积滞，是指小儿内伤乳食，停聚中焦，积而不化，气滞不行所致的疾病，以脘腹胀满、嗳气酸腐、不思乳食、食而不化、大便溏薄或秘结酸臭为临床特征。西医学的小儿消化不良表现为上述症状者，可参考此内容辨证论治。（一）乳食内积证：【症状】不思乳食，嗳腐酸馊，或呕吐食物、乳片，脘腹胀满疼痛，大便酸臭或便秘，烦躁啼哭，夜眠不安，手足心热。舌质红，苔白厚，或黄厚腻，脉弦滑，或指纹紫滞。【方剂应用】基础方剂为乳积用消乳丸（A错）（香附、神曲、麦芽、陈皮、砂仁、甘草）加减；食积用保和丸（山楂、神曲、半夏、茯苓、陈皮、连翘、莱菔子）加减。（二）脾虚夹积证：【症状】面色萎黄，形体消瘦，神疲肢倦，不思乳食，食则饱胀，腹满喜按，大便溏稀酸腥，夹有乳片或不消化食物残渣。舌质淡，苔白腻，脉细滑，或指纹淡滞。【方剂应用】基础方剂为健脾丸（B错）（人参、白术、陈皮、麦芽、山楂、神曲、枳实）加减。二陈汤（E错）为粉刺痰湿瘀滞证的方剂应用。粉刺痰湿瘀滞证：【症状】皮疹颜色暗红，以结节、脓肿、囊肿、瘢痕为主，或见窦道，经久难愈；伴纳呆腹胀。舌质暗红或有瘀斑，苔黄腻，脉弦滑。【方剂应用】基础方剂为二陈汤（半夏、陈皮、茯苓、甘草）合桃红四物汤（桃仁、红花、当归、白芍、川芎、熟地）加减。方剂应用为枳术丸（C错）的病证，2022年考试指南未明确说明。